从子宫双角前面止于双侧大阴唇
A. 卵巢固有韧带
B. 主韧带
C. 骶韧带
D. 骨盆漏斗韧带
E. 圆韧带

正确答案：E。圆韧带

解析：圆韧带起于子宫两侧角的前面，输卵管近端的下方，向前下方伸展达两侧骨盆壁，穿过腹股沟终止于大阴唇前端（E对）。卵巢呈扁椭圆状，外侧以骨盆漏斗韧带与盆壁相连，内侧以卵固有韧带与子宫相连（A错）。主韧带位于阔韧带下部，横行于宫颈两侧和骨盆侧壁之间（B错）。骶韧带从宫颈后面的上侧方，向两侧绕过直肠到达第2、3骶椎前面的筋膜（C错）。阔韧带外1/3部由伞端下方向外延伸达骨盆壁的的部分称骨盆漏斗韧带（D错）。